属于延长动作电位时程药（第Ⅲ类）的抗心律失常药的是
A. 维拉帕米
B. 胺碘酮
C. 美西律
D. 拉贝洛尔
E. 普鲁卡因胺

正确答案：B。胺碘酮

解析：本题考查胺碘酮。胺碘酮（B对）为延长动作电位时程的药，通过阻断介导复极的钾通道而延长心脏动作电位时程，用于治疗室上性和室性心律失常。维拉帕米（A错）为钙通道阻滞剂，用于心绞痛，室上性心律失常，原发性高血压。美西律（C错）属于Ⅰb类抗心律失常药，临床用于室性心律失常。拉贝洛尔（D错）为β受体阻断剂，产生周围血管舒张作用。普鲁卡因胺（E错）属于Ⅰa类钠通道阻滞剂，属于广谱抗心律失常药。